治疗孕妇生殖道感染首选
A. 红霉素
B. 多西环素
C. 青霉素
D. 氧氟沙星
E. 阿莫西林

正确答案：C。青霉素

解析：治疗孕妇生殖道感染首选青霉素（C对）。孕妇禁用多西环素（B错）、喹诺酮类（氧氟沙星为喹诺酮类抗生素）（D错）和四环素。红霉素（A错）对孕妇和胎儿感染疗效差。阿莫西林（D错）主要用于治疗伤寒、其他沙门菌感染和伤寒带菌者可获得满意疗效。